高血压伴低钾血症患者慎用的药物是
A. 依那普利
B. 氢氯噻嗪
C. 美托洛尔
D. 氨氯地平
E. 哌唑嗪

正确答案：B。氢氯噻嗪

解析：本题考查药物的不良反应。高血压伴低钾血症患者慎用的药物是氢氯噻嗪（B对）。氢氯噻嗪为噻嗪类利尿剂，可引起低血钾，长期应用者应定期监测血钾，并适量补钾。依那普利（A错）为血管紧张素转换酶抑制剂，血管紧张素转换酶抑制剂（ACEI）禁用于双侧肾动脉狭窄、高钾血症及妊娠期。美托洛尔（C错）为β受体阻断剂，禁用于二至三度房室传导阻滞、严重支气管哮喘患者。氨氯地平（D错）为二氢吡啶类钙通道阻滞剂，没有绝对禁忌证，但心动过速与心力衰竭患者应慎用。哌唑嗪（E错）为α受体阻断剂，禁用于体位性低血压患者。